以下不能借助骨移植术以恢复外形
A. 额骨缺损
B. 颧骨缺损
C. 髋骨缺损
D. 颅骨缺损
E. 鼻骨缺损

正确答案：C。髋骨缺损

解析：本题考查骨移植。髋骨缺损（C错，为本题正确答案）不能借助骨移植术以恢复外形。颧骨（B对）、鼻骨（E对）、额骨（A对）甚至颅骨（D对）缺损时，也可借助骨移植术以恢复外形。